与呋喃唑酮同用会出现呼吸困难、头痛、恶心的是
A. 各种白酒
B. 乳酪食品
C. 葡萄柚汁
D. 盐腌海鱼
E. 茶叶

正确答案：A。各种白酒

解析：本题考查饮食对药物疗效的影响。与呋喃唑酮同用会出现呼吸困难、头痛、恶心的是各种白酒（A对）。呋喃唑酮是硝基呋喃类抗生素，服用期间饮酒可引起双硫仑样反应，表现为皮肤潮红、发热、头痛、恶心、腹痛、心动过速、血压升高等。乳酪食品（B错）含酪胺，如果同时服用单胺氧化酶抑制药，酪胺难以代谢而积蓄，造成交感神经兴奋，发生严重高血压危象等严重中毒反应，甚至死亡。葡萄柚汁（C错）主要影响CYP3A4代谢，同时可抑制CYP3A4的活性。盐腌海鱼（D错）为高蛋白食物，服用抗拮抗药异烟肼时，不宜食用富含组胺的鱼类。茶叶（E错）含大量的鞣酸，鞣酸能与药中的多种金属离子结合而发生沉淀，因此服药时不宜饮茶。